受体对配体具有高度识别能力，对配体的化学结构与立体结构具有专一性，这一属性属于受体的
A. 可逆性
B. 饱和性
C. 特异性
D. 灵敏性
E. 多样性

正确答案：C。特异性

解析：本题考查受体。受体对配体具有高度识别能力，对配体的化学结构与立体结构具有专一性，这一属性属于受体的特异性（C对）。受体对其配体有高度识别能力，对配体的化学结构与立体结构具有很高的专一性，特定的受体只能与其特定的配体结合，产生特定的生物学效应。可逆性（A错）：配体与受体的结合是可逆的，配体与受体复合物可以解离，解离后可得到原来的配体而非代谢物。饱和性（B错）：受体数量有限，能与其结合的配体量也有限，因此受体具有饱和性，在药物的作用上反映为最大效应。受体具有饱和性，因此作用于同一受体的配体之间存在竞争现象。灵敏性（D错）：受体能识别周围环境中微量的配体，只需很低浓度的配体就能与受体结合而产生显著的效应。多样性（E错）：同一受体可广泛分布千不同组织或同一组织不同区域，受体密度不同。受体多样性是受体亚型分类的基础，受体受生理、病理和药理因素调节，处于动态变化之中。